单子叶植物根茎类中药材横切面上通常可见的一圈环纹是
A. 木栓形成层
B. 皮层中的纤维束环带
C. 皮层中的石细胞环带
D. 内皮层
E. 形成层

正确答案：D。内皮层